根据专家个人多年临床经验提出的诊断和治疗方案属于
A. 一级证据
B. 二级证据
C. 三级证据
D. 四级证据
E. 五级证据

正确答案：E。五级证据